一侧收缩时，使舌尖伸向对侧的肌是
A. 颏舌肌
B. 舌骨舌肌
C. 茎突舌肌
D. 腭舌肌
E. 以上都不是

正确答案：A。颏舌肌

解析：单侧收缩时，颏舌肌(A对)可使舌尖伸向对侧。